男，21岁。头痛，嗜睡伴发热，意识不清加重，大小便失禁，全身强直性抽搐半分钟，脑脊液检查蛋白质，糖，氯化物均在正常值范围内。最可能疾病为
A. 流行性乙型脑炎
B. 钩端螺旋体病
C. 单纯疱疹性脑炎
D. 病毒性肝炎
E. 肾综合征出血热

正确答案：A。流行性乙型脑炎

解析：21岁男性患者，头痛，嗜睡伴发热，意识不清加重（乙脑极期脑实质受损症状），大小便失禁，全身强直性抽搐半分钟（出现其他神经系统症状），脑脊液检查蛋白质，糖，氯化物均在正常值范围内（乙脑少数病例在病初脑脊液检查正常），最可能疾病为流行性乙型脑炎（A对），临床上以高热、意识障碍、抽搐、病理反射及脑膜刺激征为特征。钩端螺旋体病（B错）脑膜脑炎型会出现严重头痛、烦躁、颈抵抗、布氏征阳性等脑膜炎表现，以及嗜睡、神志不清、谵妄、瘫痪、抽搐与昏迷等脑炎表现，脑脊液检查蛋白增加，糖正常或稍低，氯化物正常（P256）。单纯疱疹病毒性脑炎（C错）又称急性坏死性脑炎多有口唇或生殖道疱疹史，发病有皮肤、黏膜疱疹，有咳嗽等上呼吸道感染前驱症状，有明显的脑实质损害症状，脑脊液检查蛋白轻度增加，糖正常与氯化物正常。病毒性肝炎（P17）（D错）急性多见于甲肝和戊肝，以胃肠道症状居多。肾综合征出血热（P77）（E错）有“三红”（球结膜充血、咽充血、腋下条索状出血点）“三痛”（头痛、眼痛、腰痛）典型症状，无脑膜炎症状。